结构类型为甾体化合物是
A. 斑蝥素
B. 胆酸
C. 麝香酮
D. 水蛭素
E. 牛磺酸

正确答案：B。胆酸

解析：本题考查的是化学结构类型。结构类型为甾体化合物是胆酸（B对）。天然胆汁酸是胆烷酸的衍生物，在动物的胆汁中它们通常与甘氨酸或牛磺酸的氨基以酰胺键结合成甘氨胆汁酸或牛磺胆汁酸，并以钠盐形式存在。胆烷酸的结构中有甾体母核。甾体母核A/B环为顺式稠合时称为正系，若为反式稠合则为别系，如胆酸为正系，别胆酸则为别系。胆汁酸的分布较广，从动物的胆汁中发现的胆汁酸超过100种，最常见的如胆酸、去氧胆酸、猪去氧胆酸、鹅去氧胆酸、熊去氧胆酸等。斑蝥素（A错）为斑蝥的主要化学成分。斑蝥中主要含单萜类成分：斑蝥素，还含脂肪、树脂、蚁酸及多种微量元素等。斑蝥素是其有效成分，也是毒性成分。《中国药典》规定，斑蝥含斑蝥素不得少于0.35%。麝香酮（C错）为麝香的主要化学成分。麝香的化学成分较为复杂，其中的麝香酮（L-3-甲基十五环酮）是天然麝香的有效成分之一。《中国药典》以麝香酮为指标成分进行含量测定，要求麝香酮含量不得少于2.0%。此外，麝香中还含有降麝香酮，麝香吡啶和羟基麝香吡啶A、B等10余种雄甾烷衍生物，而且还有多肽、脂肪酸、胆甾醇及其酯和蜡等。水蛭素（D错）为水蛭的的主要化学物质。水蛭主含蛋白质，含有17种氨基酸，水解氨基酸含量达49.4%，包括人体必需的8种氨基酸，其中谷氨酸含量高达8.3%；还含有Zn、Mn、Fe、Co、Cr、Se、Mo、Ni等14种微量元素。水蛭素是水蛭的主要有效药用成分，是一种含有65个氨基酸残基的单链多肽。牛磺酸（E错）为牛黄的主要化学成分。牛黄约含8%胆汁酸，主要成分为胆酸、去氧胆酸和石胆酸。此外，还含有7%SMC及胆红素，胆固醇，麦角固醇，多种氨基酸（如丙氨酸、甘氨酸、牛磺酸、精氨酸、天冬氨酸、蛋氨酸等）和无机盐等。《中国药典》以胆酸和胆红素为牛黄的质量控制成分，要求胆酸含量不少于4.0%，胆红素含量不得少于25.0%。